一名未接种过卡介苗的健康中年人，做结核菌素试验是阳性，下列哪项解释不正确
A. 需要接种卡介苗
B. 不需要接种卡介苗
C. 对结核病有免疫力
D. 细胞免疫功能正常
E. 感染过结核分枝杆菌

正确答案：A。需要接种卡介苗